下颌根尖片无法看到的解剖结构
A. 颏嵴
B. 喙突
C. 营养管
D. 下颌管
E. 下颌骨外斜线

正确答案：B。喙突

解析：本题考查下颌根尖片。喙突（B错，为本题正确答案）是下颌根尖片无法看到的解剖结构。下颌根尖片所见有关颌骨正常解剖结构有：颏棘、颏嵴（A对）、营养管（C对）等结构；在下颌前磨牙位根尖片常可见颏孔；在下颌磨牙位根尖片常可见下颌骨外斜线（E对）、下颌管（D对）及下颌骨下缘等结构。